气管颈段中有甲状腺峡部横过是哪一段
A. 第1～2气管软骨环的前方
B. 第2～4气管软骨环的前方
C. 第3～5气管软骨环的前方
D. 第4～6气管软骨环的前方
E. 第6～8气管软骨环的前方

正确答案：B。第2～4气管软骨环的前方

解析：在气管颈段第2～4气管软骨环的前方有甲状腺峡部横过。气管颈段的两侧，上部有甲状腺侧叶覆盖，下部与颈总动脉相邻。掌握“气管颈段、颈动脉三角的解剖特点及临床应用”知识点。